卡介苗接种成功的标准
A. 卡介苗接种后，结素试验阳转率，农村在75%以上
B. 卡介苗接种后，结素试验阳转率，农村在85%以上
C. 卡介苗接种后，结索试验阳转率在80%以上
D. 卡介苗接种后，结素试验阳转率在75%以上
E. 卡介苗接种后，结素试验阳转率在85%以上

正确答案：A。卡介苗接种后，结素试验阳转率，农村在75%以上